介导ADCC的是
A. CD3
B. IgG
C. IFN-γ
D. IL-4
E. CD4

正确答案：B。IgG

解析：ADCC是指抗体依赖的细胞介导的细胞毒性作用，指具有杀伤活性的细胞如NK细胞通过其表面表达的Fc受体识别包被于靶抗原上抗体的Fc段，直接杀伤靶细胞，故介导ADCC的是IgG（B对）。CD3（A错）、CD4（E错）是T细胞表达的表面抗原。IFN-γ（C错）为活化T细胞和NK细胞分泌的细胞因子，主要功能是抗病毒，激活巨噬细胞，促进MHC分子表达和抗原提呈，促进Th1细胞的分化，抑制Th2细胞分化，促进CTL功能。IL-4（D错）由Th2细胞、嗜碱性粒细胞分泌，主要功能是刺激B细胞增值，参与Th2细胞分化，促进IgE生成。